地方性砷中毒
A. 经食物链传递而富集最终影响人体健康的是
B. 胚胎期和婴儿发育早期机体严重碘缺乏可引起
C. 污水灌溉农田使农作物受污染而危害人体健康的是
D. 引起居民以斑釉齿和骨骼损害为特征的疾病是
E. 以皮肤损害为显著特点的生物地球化学性疾病为

正确答案：E。以皮肤损害为显著特点的生物地球化学性疾病为

解析：本题考查地方性砷中毒。以皮肤损害为显著特点的生物地球化学性疾病为（E对ABCD错）地方性砷中毒。地方性砷中毒是由于长期自饮用水、室内煤烟、食物等环境介质中摄入过量的砷而引起的一种生物地球化学性疾病。临床上以末梢神经炎、皮肤色素代谢异常、掌跖部皮肤角化、肢端缺血坏疽、皮肤癌变为主要表现，是一种伴有多系统、多脏器受损的慢性全身性疾病。